戴全口义齿讲话和进食时上下牙有撞击声。是由于
A. 排牙不准确
B. 下颌前伸
C. 下颌后退
D. 垂直距离过低
E. 垂直距离过高

正确答案：E。垂直距离过高

解析：本题考查全口义齿颌位关系及上（牙合）架。垂直距离恢复得过大（E对）表现为面部下1/3距离增大，面部肌肉紧张，表情僵硬，口唇闭合困难，颏部皮肤皱缩，颏唇沟变浅。大开口时上下前牙切端间距离过小，息止颌间隙过小，说话或进食时义齿人工牙有撞击声，义齿不稳定，容易脱位。可能出现黏膜压痛，面部酸痛，颞下颌关节不适，咀嚼费力，咀嚼效率低下。